主要对M受体有阻断作用的药物有
A. 新斯的明
B. 普鲁本辛
C. 毛果芸香碱
D. 山莨菪碱
E. 胃复康

正确答案：B、D、E。普鲁本辛；山莨菪碱；胃复康

解析：本题考查对M受体有阻断作用的药物。对M受体有阻断作用的药物有：普鲁本辛（B对）、山莨菪碱（D对）、胃复康（E对）。山莨菪碱为胆碱M受体阻断剂，作用与阿托品相似或稍弱；苯胺太林（普鲁本辛）和贝那替嗪（胃复康）是阿托品的合成代用品，对胃肠道M受体选择性阻断作用强，主要用于胃肠道解痉；新斯的明（A错）是可逆性抗胆碱酯酶药；毛果芸香碱（C错）为拟M胆碱药，有缩小瞳孔和降低眼压作用。